男，60岁，食道癌术后行放射治疗，血小板90×10⁹/L，此时决定治疗是否停止的指标是白细胞计数低于
A. 1×10⁹/L
B. 2×10⁹/L
C. 3×10⁹/L
D. 4×10⁹/L
E. 5×10⁹/L

正确答案：C。3×10⁹/L

解析：放疗可抑制骨髓造血，影响血细胞的生成，使白细胞和血小板数量降低，因此在放疗期间应至少一周查一次血象，监测血细胞的变化，当白细胞少于3×10⁹/L（C对），血小板少于80×10⁹/L时应暂停放疗，采用升白细胞药物治疗，待血象恢复后再行放疗。